健脾丸中含有的药物是
A. 白术、木香、半夏
B. 白术、木香、连翘
C. 白术、茯苓、连翘
D. 白术、木香、黄连
E. 白术、茯苓、半夏

正确答案：D。白术、木香、黄连

解析：健脾丸中含有白术、木香、黄连（D对）。趣记：用蔻三仙，香砂六君山药煎-肉豆蔻+焦三仙+香砂六君丸+山药。